有机磷农药经吸收常是职业性中毒的主要途径
A. 消化系统
B. 呼吸系统
C. 皮肤
D. 粘膜

正确答案：C。皮肤

解析：本题考查有机磷农药的吸收。有机磷农药可经胃肠道、呼吸道以及完好的皮肤或黏膜吸收。经呼吸道或胃肠道进入人体时，吸收较为迅速而完全。皮肤吸收（C对ABD错）是急性职业性中毒的主要途径。吸收后迅速随血液及淋巴循环分布到全身各器官组织，其中以肝脏含最最高，可通过血脑屏障。有的还能通过胎盘屏障到达胎儿体内。脂溶性高的有机磷农药能少量储存于脂肪组织中延期释放。